食品必须符合以下要求，但除外
A. 应当无毒、无害
B. 符合应当有的营养要求
C. 具有相应的色、香、味等感官性状
D. 专供婴幼儿的主、辅食品，必须符合国务院卫生行政部门制定的营养卫生标准
E. 具有特定保健功能

正确答案：E。具有特定保健功能